根据《麻醉药品和精神药品管理条例》，医院从药品批发企业购进第一类精神药品时
A. 应由医院自行到药品批发企业提货
B. 应由药品批发企业将药品运至医院
C. 应由公安部门协助药品批发企业将药品送至医院
D. 应由公安部门协助医院到药品批发企业提货
E. 应由公安部门监督药品批发企业将药品送至医院

正确答案：B。应由药品批发企业将药品运至医院

解析：本题考查麻醉药品和精神药品销售配送要求。根据《麻醉药品和精神药品管理条例》，医院从药品批发企业购进第一类精神药品时应由药品批发企业将药品运至医院（B对）。麻醉药品和精神药品销售配送要求：（1）全国性批发企业和区域性批发企业向医疗机构销售麻醉药品和第一类精神药品，应当将药品送至医疗机构。医疗机构不得自行提货（A错）。（2）企业销售出库的第二类精神药品不允许购货单位自提，须由供货企业将药品送达医疗机构库房或购买方注册的仓库地址。（3）药品零售连锁企业对其所属的经营第二类精神药品的门店，应当严格执行统一进货、统一配送和统一管理。药品零售连锁企业门店所零售的第二类精神药品，应当由本企业直接配送，不得委托配送。